视交叉中心部位断离可导致
A. 双眼鼻侧视野缺失
B. 双眼全盲
C. 双眼对光反射消失
D. 双眼颞侧视野缺失
E. 双眼角膜反射消失

正确答案：D。双眼颞侧视野缺失

解析：当视觉传导通路的不同部位受损时，可引起不同的视野缺损： 视网膜损伤引起的视野缺损与损伤的位置和范围有关； 一侧视神经损伤可致该侧眼视野全盲（B错）； 视交叉中交叉纤维损伤可致双眼视野颞侧半偏盲（D对）； 一侧视交叉外侧部的不交叉纤维损伤，则患侧眼视野的鼻侧半偏盲（A错）；一侧视束及以后的视觉传导路（视辐射、视区皮质）受损，可致双眼病灶对侧半视野同向性偏盲（如右侧受损则右眼视野鼻侧半和左眼视野颞侧半偏盲）。